植物性食物中，优质蛋白质的来源是
A. 粮食
B. 蔬菜
C. 水果
D. 大豆
E. 植物油

正确答案：D。大豆